《中华人民共和国药品管理法实施办法》规定，药品批准文号在几年内不得变更
A. 五年
B. 二年
C. 四年
D. 十年
E. 三年

正确答案：A。五年

解析：本题考查药品批准文号有效期。《中华人民共和国药品管理法实施办法》规定，药品批准文号在五年（A对）内不得变更。《中华人民共和国药品管理法实施办法》第四十一条规定：国务院药品监督管理部门核发的药品批准文号、《进口药品注册证》、《医药产品注册证》的有效期为5年。有效期届满，需要继续生产或者进口的，应当在有效期届满前6个月申请再注册。药品再注册时，应当按照国务院药品监督管理部门的规定报送相关资料。有效期届满，未申请再注册或者经审查不符合国务院药品监督管理部门关于再注册的规定的，注销其药品批准文号、《进口药品注册证》或者《医药产品注册证》。